可用于分离酸性物质的极性吸附剂是
A. 凝胶
B. 硅藻土
C. 硅胶
D. 活性炭
E. 三氧化二铝

正确答案：C。硅胶

解析：本题考查的是硅胶吸附色谱法和氧化铝吸附色谱法。可用于分离酸性物质的极性吸附剂是硅胶（C对）。硅胶吸附色谱法和氧化铝吸附色谱法添加溶剂的选择：为避免发生化学吸附，酸性物质宜用硅胶，碱性物质则宜用氧化铝（E错）进行分离。凝胶（A错）为是凝胶色谱法的填充剂。凝胶色谱法：凝胶色谱法也称凝胶过滤法、凝胶渗透色谱法、分子筛过滤或排阻色谱，是根据物质分子大小差别进行分离。硅藻土（B错）与活性炭合用也可通过吸附除去注射剂的热原。活性炭（D错）是非极性吸附剂，与硅胶、氧化铝相反，对非极性物质具有较强的亲和能力，在水中对溶质表现出强的吸附能力。溶剂极性降低，则活性炭对溶质的吸附能力也随之降低。故从活性炭上洗脱被吸附物质时，洗脱溶剂的洗脱能力将随溶剂极性的降低而增强。